“阴在内，阳之守也；阳在外，阴之使也。”说明阴阳的关系是
A. 对立
B. 互根
C. 互用
D. 消长
E. 转化

正确答案：C。互用

解析：阴在内，阳之守也，阳在外，阴之使也指出阳以阴为基，阴以阳为偶；阴为阳守持于内，阳为阴役使于外，阴阳相互为用，不可分离。（C对）。阴阳的相互对立（A错）主要表现于它们之间的相互斗争、相互制约，如《管子·心术上》上说“阴则能制阳也，静则能制动也”。阴阳互根（B错）指一切事物或现象中相互对立的阴阳两个方面，具有相互依存，互为根本的关系，阴阳的任何一方都不能脱离另一方而单独存在，每一方都以相对的另一方的存在作为自己存在的前提和条件。阴阳消长（D错）指对立互根的阴阳双方不是一成不变的，而是处于不断的增长和消减变化中。阴阳双方在彼此消长的运动过程中保持着动态平衡。阴阳转化（E错）是指在一定条件下，事物的总体属性可以向其相反的方向转化，即属阳的事物可以转化为属阴的事物。